人摄取的食物中含有丰富的磷，磷的吸收部位在
A. 胃
B. 小肠
C. 大肠
D. 均可以被吸收
E. 均不可以被吸收

正确答案：B。小肠

解析：人摄取的食物中含有丰富的磷，磷的吸收部位在小肠。掌握“钙、磷、氟”知识点。